男，13岁。右股骨下端疼痛2个月，夜间加重。查体：右股骨下端局部肿胀、皮温增高。X线示右胫上端日光射线样改变。首先考虑的诊断是
A. 慢性骨髓炎
B. 骨巨细胞瘤
C. 骨样骨瘤
D. 股骨结节骨软骨病
E. 骨肉瘤

正确答案：E。骨肉瘤

解析：青少年男性患者，右股骨下端疼痛2个月，夜间加重，查体：右股骨下端局部肿胀、皮温增高。X线示右胫上端日光射线样改变（骨肉瘤典型影像学表现），结合患者症状、体征和影像学表现，最可能的诊断是左胫骨近端骨肉瘤（E对）。慢性骨髓炎（A错）在病变不活动阶段可以无症状，有局部肿胀，骨质增厚，表面粗糙，肢体增粗及变形，如有窦道，伤口长期不愈，偶有小块死骨排出，有时伤口暂时愈合，但由于存在感染病灶，炎症扩散，可引起急性发作，表现为疼痛，表面皮肤红、肿、热及压痛，X线平片可显示有虫蛀状骨破坏与骨质稀疏，并逐渐出现硬化区。骨巨细胞瘤（B错）X线片特征性表现为骨端偏心性、溶骨性、囊性破坏而无骨膜反应，病灶呈肥皂泡样改变。骨样骨瘤（C错）主要症状是疼痛，有夜间痛，进行性加重，多可服用阿司匹林止痛，并以此作为诊断依据。若病损在关节附近，可出现关节炎症状，影响关节功能。胫骨结节骨软骨病（D错）主要表现为胫骨结节处疼痛、肿胀，严重时甚至累及膝关节，导致活动受限。